女，50岁。2天前发热、咳嗽，给予吸氧、静脉滴注抗生素、止咳、化痰等治疗。1天来出现呼吸困难，烦躁，呼吸急促。动脉血气分析：PH7.44，PaCO₂30mmHg，PaO₂55mmHg，BE-3mmol/L目前对血气分析的判断，最准确的是
A. 代谢性酸中毒
B. Ⅰ型呼吸衰竭
C. 呼吸性酸中毒
D. Ⅱ型呼吸衰竭
E. 代谢性酸中毒合并呼吸性碱中毒

正确答案：B。Ⅰ型呼吸衰竭

解析：患者PH7.44（正常，正常7.35～7.45），PaCO₂30mmHg（降低，正常35～45mmHg），PaO₂55mmHg（低，正常95～100 mmHg），BE-3mmol/L（正常，即0±3mmol/L）。综上所述，患者PaO₂＜60mmHg，PaCO₂降低，有缺氧而无CO₂潴留，诊断为I型呼吸衰竭（D错），PH及剩余碱（BE）均正常，无酸碱代谢失衡（E错）。Ⅱ型呼吸衰竭（D错）为缺氧伴有CO₂潴留（PaO₂＜60mmHg，PaCO₂＞50mmHg）。